慢性肾功能衰竭主要表现除肾功能减退，代谢产物潴留外还表现
A. 尿白细胞增多或尿菌（+）
B. 腰痛和下腹部疼痛，寒战发热，肾区叩痛（+）
C. 间歇性无症状性细菌尿和间歇性尿频、尿急
D. 水、电解质紊乱及酸碱平衡失调
E. 有多尿期，达3000～5000ml/d

正确答案：D。水、电解质紊乱及酸碱平衡失调

解析：慢性肾功能衰竭主要表现除肾功能减退，代谢产物潴留外还表现水、电解质紊乱及酸碱平衡失调（D对），以代谢性酸中毒和水、钠平衡紊乱最常见。尿白细胞增多或尿菌（+）提示泌尿系感染（A错）。腰痛和下腹部疼痛，寒战发热，肾区叩痛（+），提示急性肾盂肾炎（B错）。间歇性无症状性细菌尿和间歇性尿频、尿急提示慢性肾盂肾炎（C错）。有多尿期，达3000～5000ml/d为急性肾损伤的表现（E错）。